千柏鼻炎片除宜肺通窍、活血祛风外，又能
A. 化痰散结
B. 芳香化浊
C. 清热解毒
D. 祛痰利咽
E. 利湿退黄

正确答案：C。清热解毒

解析：本题考查的是千柏鼻炎片的功能。千柏鼻炎片除宜肺通窍、活血祛风外，又能清热解毒（C对）。千柏鼻炎片：【功能】清热解毒，活血祛风，宣肺通窍。黄氏响声丸：【功能】疏风清热，化痰散结（A错），利咽开音。藿胆片：【功能】芳香化浊（B错），清热通窍。玄麦甘桔含片：【功能】清热滋阴，祛痰利咽（D错）。茵栀黄口服液：【功能】清热解毒，利湿退黄（E错）。